治疗肺炎热陷心包证，应首选
A. 清营汤
B. 化斑汤
C. 白虎汤
D. 苇茎汤
E. 止嗽散

正确答案：A。清营汤

解析：肺炎热陷心包证，治宜清热解毒，化痰开窍，清营解毒，透热转阴的清营汤最为适宜（A对）。化斑汤主治气血两燔之发斑（B错）。白虎汤功用清热生津，主治阳明气分热盛证（C错）。苇茎汤功用清肺化痰，逐瘀排脓，主治肺痈，热毒壅滞，痰瘀互结证（D错）。止嗽散功用宣利肺气，疏风止咳，主治风邪犯肺之咳嗽证（E错）。